在下列文献中，最早提出不伤害原则的是
A. 《希波克拉底誓言》
B. 《千金要方》
C. 《纽伦堡法典》
D. 《夏威夷宣言》
E. 《赫尔辛基宣言》

正确答案：A。《希波克拉底誓言》